可加速丁香油氧化锌水门汀结固的因素是
A. 液中加橄榄油
B. 调拌中与水接触
C. 粉中加磷酸锌
D. 粉中减少硬脂酸锌

正确答案：B。调拌中与水接触

解析：本题考查氧化锌丁香油水门汀的性能-凝固时间。因为水分能促使氧化锌解离出更多的锌离子，因此调拌中丁香油氧化锌水门汀与水接触（B对）会加速其凝固。液中加橄榄油（A错）能增加丁香油氧化锌水门汀的黏性与韧性,但不能加速其结固。粉中加醋酸锌能加速丁香油氧化锌水门汀的凝固，而不是磷酸锌（C错）。粉中减少硬脂酸锌（D错）能减少丁香油氧化锌水门汀的塑性，减缓凝固。